药物不良反应
A. 一般都很严重
B. 发生在大剂量情况下
C. 产生原因与药物作用的选择性高有关
D. 发生在治疗剂量
E. 可以避免

正确答案：D。发生在治疗剂量

解析：按照WHO国际药物监测合作中心的规定，药物不良反应是指正常剂量（治疗剂量）的药物（D对）用于预防、诊断、治疗疾病或调节生理机能时出现的有害的和与用药目的无关的反应。药物不良反应包括副反应（多数较轻微并可以预料）、毒性反应（一般比较严重）、后遗反应、停药反应、变态反应（反应的严重程度差异很大）、特异质反应（反应的严重程度与剂量成正比）（A错）。发生在大剂量情况下（B错）的是不良反应中的毒性反应。药物作用的选择性较高（C错），药物不良反应少，其并不是药物不良反应产生的原因。药物不良反应多数是药物的固有效应，一般情况下是可以预知的，但不一定是能够避免的（E错）。